手指麻木伴上肢放射痛，压头试验阳性，最可能的颈椎病类型是
A. 椎动脉型颈椎病
B. 脊髓型颈椎病
C. 交感神经型颈椎病
D. 神经根型颈椎病
E. 复合型颈椎病

正确答案：D。神经根型颈椎病

解析：手指麻木、皮肤过敏等感觉异常，上肢放射痛，压头试验阳性（Spurling征），牵拉试验阳性等为神经根型颈椎病（D对）的典型表现。椎动脉型颈椎病（A错）主要表现为突发性眩晕而猝倒、偏头痛、听力减退或耳聋、视力障碍等。脊髓型颈椎病（B错）表现为上肢或下肢麻木无力、僵硬、双足踩棉花感，足尖不能离地，触觉障碍、束胸感，双手精细动作笨拙，不能用筷子进食，肌力减退，四肢腱反射活跃或亢进，Hoffmann征、髌阵挛、踝阵挛及Babinski征等阳性。交感神经型颈椎病（C错）主要表现为交感神经受刺激的症状，可为兴奋性也可为抑制性。复合型颈椎病（E错）少见，多有两种或多种症状同时出现。